獐牙菜苦苷是
A. 三萜类化合物
B. 黄烷类化合物
C. 挥发油
D. 二萜类化合物
E. 裂环环烯醚萜类化合物

正确答案：E。裂环环烯醚萜类化合物

解析：本题考查的是环烯醚萜类。獐牙菜苦苷是裂环环烯醚萜类化合物（E对）。裂环环烯醚萜苷：此类化合物是由环烯醚萜苷元部分C-7和C-8位处开环衍生而来，C-7断裂后有时还可与C-11形成六元内酯结构。裂环环烯醚萜苷在龙胆科、睡菜科、茜草科、忍冬科、木犀科等植物中分布较广，在龙胆科的龙胆属及獐牙菜属分布更为普遍。如龙胆中主要有效成分和苦味成分龙胆苦苷，獐牙菜中的苦味成分獐牙菜苷及獐牙菜苦苷等。三萜类化合物（A错）：基本骨架由6个异戊二烯单位组成。三萜的种类很多，但以皂苷形式存在的三萜类型并不多，较为常见的有羊毛甾烷型、达玛烷型、齐墩果烷型、乌苏烷型和羽扇豆烷型，其中前两种属于四环三萜，后三种则属于五环三萜。（1）四环三萜：结构与甾醇很类似。主要有以下类型。①羊毛甾烷型，如猪苓酸A。②达玛烷型，如20（S）-原人参二醇。（2）五环三萜：主要有以下类型。①齐墩果烷型：此类以齐墩果酸最为多见。②乌苏烷型，此类大多是乌苏酸的衍生物。③羽扇豆烷型，如羽扇豆种子中存在的羽扇豆醇，酸枣仁中分得的白桦醇和白桦酸等。黄烷类化合物（B错）属于黄酮类物质，常见的有儿茶素。挥发油类化合物（C错）也称精油，是存在于植物体内的一类可随水蒸气蒸馏、与水不相混溶的挥发性油状液体。挥发油的组成成分主要有四类：1.萜类化合物：如薄荷油含薄荷醇约80%；山苍子油含柠檬醛80%等。2.芳香族化合物：如桂皮醛、百里香酚、花椒油素等。3.脂肪族化合物：如陈皮中的正壬醇、人参挥发油中的人参炔醇、鱼腥草挥发油中的癸酰乙醛即鱼腥草素及甲基正壬酮等。4.其他类化合物：如芥子油、原白头翁素、大蒜油等，也常称之为“挥发油”。二萜类化合物（D错）：是指骨架由4个异戊二烯单位构成，含20个碳原子的一类萜类衍生物。绝大多数不能随水蒸气蒸馏。二萜多以树脂、内酯或苷等形式广泛存在于自然界。不少二萜含氧衍生物具有很好的生物活性，如穿心莲内酯、芫花酯、雷公藤内酯、银杏内酯、紫杉醇等。